根据《进口药材管理办法》，可以作为首次进口药材审批的申请人或者进口药材备案的单位是
A. 中国境内的疫苗上市许可持有人
B. 具有中药饮片经营范围的药品经营企业
C. 化学药品生产企业
D. 商品进出口贸易公司

正确答案：B。具有中药饮片经营范围的药品经营企业

解析：本题考查的是进口药材的管理部门与管理要求。根据《进口药材管理办法》，可以作为首次进口药材审批的申请人或者进口药材备案的单位是具有中药饮片经营范围的药品经营企业（B对）。药材进口单位是指办理首次进口药材审批的申请人或者办理进口药材备案的单位，应当是中国境内的中成药上市许可持有人、中药生产企业，以及具有中药材或者中药饮片经营范围的药品经营企业。